窝沟龋进展快是因为
A. 窝沟龋致龋菌多产酸多
B. 窝沟底部距离牙髓较近
C. 窝沟釉质较光滑面釉质薄
D. 龋向邻近釉质和釉牙本质界发展
E. 刷牙难使窝沟清洁

正确答案：C。窝沟釉质较光滑面釉质薄

解析：由于窝沟底部釉质厚度较平滑面薄，窝沟龋发生后较平滑面龋发展迅速。窝沟底部与牙本质非常接近，当窝沟患龋时，容易迅速波及牙本质，导致临床上可探查到的损害。而发生在平滑面的龋损要达到牙本质则需要较长时间，在这段时间里可以采取预防措施使病损过程停止。掌握“窝沟封闭术”知识点。